喉软骨构成喉的支架，喉软骨包括甲状软骨、环状软骨、会厌软骨和成对的杓状软骨。关于甲状软骨的叙述，下列哪项是正确的
A. 不组成喉的软骨支架
B. 有四边形的左板和右板
C. 两板融合成直角称喉结
D. 上角与环状软骨构成环甲关节
E. 下角与舌骨大角相连

正确答案：B。有四边形的左板和右板

解析：甲状软骨组成喉的软骨支架（A错）。甲状软骨有四边形的左板和右板（B对）。左、右软骨板的融合处称前角，前角上端向前突出，称为喉结（C错）。上角与舌骨大角相连（D错）；下角与环状软骨相连（E错）。